可引起水杨酸反应的药物是
A. 阿司匹林
B. 非那西丁
C. 保泰松
D. 对乙酰氨基酚
E. 羟基保泰松

正确答案：A。阿司匹林